患者腰痛以痠软为主，喜按喜揉，腿膝无力，遇劳更甚，卧则减轻。治疗应选用
A. 牛膝
B. 桃仁
C. 红花
D. 郁金
E. 鸡血藤

正确答案：A。牛膝

解析：腰痛以痠软为主，腿膝无力，喜按喜揉，遇劳更甚，卧则减轻，证属肝肾亏虚，治以补肝肾，强筋骨。牛膝具有活血祛瘀，补肝肾，强筋骨的功效（A对）。桃仁具有活血祛瘀，润肠通便，止咳平喘的功效，不具有补肝肾强筋骨的功效（B错）。红花具有活血通经，祛瘀止痛的功效，不具有补肝肾，强筋骨的功效（C错）。郁金具有活血止痛，行气解郁，清心凉血，利胆退黄的功效，不具有补肝肾强筋骨的功效（D错）。鸡血藤具有行血补血，调经，舒经活络的功效，不具有补肝肾，强筋骨的功效（E错）。